据《素问·阴阳应象大论》，对于病邪轻浅者，其治法是
A. 彰之
B. 扬之
C. 因而越之
D. 引而竭之
E. 减之

正确答案：B。扬之

解析：“因其轻而扬之”意为由于病邪轻浅在表而采用轻扬宣散之法（B对）。“因其衰而彰之（A错）。其高者，因而越之（C错）。其在下者，引而竭之（D错）。因其重而减之（E错）。”